女性，32岁。胃溃疡病史3年，今突发上腹剧痛，面色苍白，大汗。查体：全腹压痛，腹肌紧张，似穿孔。胃溃疡穿孔在哪一部位多见
A. 胃大弯
B. 胃小弯
C. 胃体
D. 胃窦
E. 胃底部

正确答案：B。胃小弯

解析：青年女性患者，有胃溃疡病史，今突发上腹剧痛，查体见全腹压痛、腹肌紧张（腹膜刺激症状），结合患者病史和体查，应考虑为急性胃溃疡穿孔。胃溃疡穿孔多见于胃小弯（B对）。胃溃疡出血亦多见于胃小弯侧。十二指肠溃疡穿孔多发生在球部前壁，出血多位于球部后壁。胃癌好发胃窦，胃角次之。